日常生活自理能力的丧失作为观察终点，代替普通寿命表以死亡作为观察终点，它是指
A. 减寿人年数
B. 无残疾期望寿命
C. 活动期望寿命
D. 伤残调整生命年
E. 健康期望寿命

正确答案：C。活动期望寿命